3-位是乙酰氧甲基，7-位侧链上不含有2-氨基-4-噻唑基
A. 头孢氨苄
B. 头孢羟氨苄
C. 头孢噻吩钠
D. 头孢噻污钠
E. 头孢哌酮

正确答案：C。头孢噻吩钠